兴奋在心脏内传导速度最慢的部位是
A. 心室
B. 房室束
C. 心房
D. 房室交界
E. 浦肯野纤维网

正确答案：D。房室交界